固定桥的组成部分是
A. 固位体、桥体、连接体
B. 固位体、桥体、人工牙
C. 固位体、人工牙、连接体
D. 固位体、桥体、基牙
E. 固位体、桥体、固定连接体

正确答案：A。固位体、桥体、连接体

解析：固定局部义齿（固定桥）由固位体、桥体、连接体三部分组成。掌握“固定桥的组成和分类”知识点。